不宜制成胶囊剂的药物有
A. 药物的水溶液
B. 易溶性及刺激性强的药物
C. 药物的稀乙醇液
D. 易风化的药物
E. 吸湿性药物

正确答案：A、B、C、D、E。药物的水溶液；易溶性及刺激性强的药物；药物的稀乙醇液；易风化的药物；吸湿性药物

解析：本题考查胶囊剂的质量要求。不宜制成胶囊剂的药物有药物的水溶液（A错）、易溶性及刺激性强的药物（B错）、药物的稀乙醇液（C错）、易风化的药物（D错）、吸湿性药物（E对）。不宜制成胶囊剂的药物：①药物的水溶液或稀乙醇溶液，因可使胶囊壁溶化。②刺激性强的易溶性药物，因其在胃中溶解后局部浓度过高而对胃黏膜产生较强刺激性。③易风化的药物，可使胶囊壁软化。④吸湿性强的药物，可使胶囊壁干燥变脆。